半枝莲和半边莲的共同功效是
A. 清热解毒，散瘀止血
B. 清热解毒，燥湿止带
C. 清热解毒，利水消肿
D. 清热解毒，消肿利咽
E. 清热解毒，杀虫止痒

正确答案：C。清热解毒，利水消肿

解析：本题考查的是半边莲与半枝莲的功效。半枝莲和半边莲的共同功效是清热解毒，利水消肿（C对）。半枝莲：【功效】清热解毒，散瘀止血（A错），利水消肿。半边莲：【功效】清热解毒，利水消肿。秦皮：【功效】清热解毒，燥湿止带（B错），清肝明目。山豆根：【功效】清热解毒，消肿利咽（D错）。功效为清热解毒，杀虫止痒（E错）的中药，2022年考试指南未明确说明。